纤维素性炎症的好发部位应除外
A. 心包
B. 肺
C. 气管
D. 结肠
E. 皮肤

正确答案：E。皮肤

解析：纤维素性炎是以渗出物中含有大量纤维素为特征的炎症，易发生于①黏膜：如气管内壁（C对）、结肠内壁（D对）②浆膜：如心包（A对）③肺组织（B对）。皮肤（E错，为本题正确答案）属于上皮组织，易发生蜂窝织炎（化脓性炎）。